疠气的致病特点是
A. 病情重
B. 发热
C. 易伤津耗气
D. 扰动心神
E. 传染性强

正确答案：E。传染性强

解析：疠气的致病特点为：（1）传染性强，易于流行。（2）发病急骤，病情危笃。（3）一气一病，症状相似。其中最主要的致病特点是具有强烈的传染性和流行性（E对）。